医疗机构违反药品管理法规定，从无许可证企业购进药品且情节严重的，应吊销其
A. 《药品生产许可证》
B. 《药品经营许可证》
C. 《医疗机构制剂许可证》
D. 《医疗机构执业许可证》
E. 《进口药品注册证》

正确答案：D。《医疗机构执业许可证》

解析：本题考查从无证生产、经营企业购入药品的法律责任。医疗机构违反药品管理法规定，从无许可证企业购进药品且情节严重的，应吊销其《医疗机构执业许可证》（D对）。从无证生产、经营企业购入药品的法律责任：根据《药品管理法》第一百二十九条的规定，药品上市许可持有人、药品生产企业、药品经营企业或者医疗机构未从药品上市许可持有人或者具有药品生产、经营资格的企业购进药品的，责令改正，没收违法购进的药品和违法所得，并处违法购进药品货值金额二倍以上十倍以下的罚款；情节严重的，并处货值金额十倍以上三十倍以下的罚款，吊销药品批准证明文件、药品生产许可证（A错）、药品经营许可证（B错）或者医疗机构执业许可证；货值金额不足五万元的，按五万元计算。